引发慢性牙周炎的始动因子是
A. 微生物
B. 吸烟
C. 糖尿病
D. 刷牙
E. 牙石

正确答案：A。微生物

解析：微生物是引发慢性牙周炎的始动因子。掌握“慢性牙周炎的病因，表现诊断及预后”知识点。